关于创伤按伤情轻重分类，属于轻伤的是
A. 局部软组织伤
B. 上下肢开放性骨折
C. 肌体挤压伤
D. 机械性呼吸道阻塞
E. 空腔脏器伤

正确答案：A。局部软组织伤